可复性牙髓炎临床表现的特点是
A. 患牙有深龋洞
B. 冷水入洞后痛
C. 有阵发性自发痛
D. 热测引起迟缓痛
E. 冷测一过性敏感

正确答案：E。冷测一过性敏感

解析：本题考查可复性牙髓炎的临床表现。可复性牙髓炎是牙髓组织以血管扩张、充血为主要病理变化的初期炎症表现，它相当于牙髓病的组织病理学分类中的“牙髓充血”。其临床表现为当患牙受到冷、热温度刺激或甜、酸化学刺激时，立即出现瞬间的疼痛反应，尤其冷测一过性敏感（E对）。没有阵发性自发痛 （C错）。而患牙有深龋洞（A错）及冷水入洞后痛（B错）既可为可复性牙髓炎的临床表现，也可是深龋的临床表现，不属于牙髓炎的临床特点。热测引起迟缓痛（D错）是慢性闭锁性牙髓炎或牙髓钙化等疾病的临床表现。